下列各项，不属于糖尿病主要中医病因的是
A. 禀赋不足
B. 饮食失节
C. 外感六淫
D. 情志失调
E. 劳欲过度

正确答案：C。外感六淫

解析：糖尿病发生的主要中医病机是阴津亏损，燥热偏盛。禀赋不足（A对）、饮食失节（B对）、情志失调（D对）、劳欲过度（E对）和外感邪热等均可致阴虚燥热而发为消渴。外感六淫（C错，为本题正确答案）不是糖尿病的中医病因。